穿过食管膈肌裂孔的是
A. 主动脉
B. 下腔静脉
C. 气管
D. 迷走神经
E. 胸导管

正确答案：D。迷走神经

解析：穿过食管膈肌裂孔的是迷走神经（D对）与食管，答案选D。